水痘的好发年龄是
A. 1岁以内
B. 1岁-4岁
C. 5-8岁
D. 9-12岁
E. 儿童时期任何年龄

正确答案：C。5-8岁

解析：水痘是由水痘时邪引起的一种传染性强的出疹性疾病，儿童时期任何年龄皆可发病，七版教材言以及大纲标注6~9岁儿童最为多见，五版教材言1-4岁为多见，以最新教材及大纲为准（C对）。1岁以内，奶麻多见（A错）。9-12岁儿童其免疫功能趋于完善，故不好发水痘等儿童传染病（D错）。儿童时期任何年龄皆可发病，但本题问的是好发年龄，此非正确答案（E错）。